选择固定桥基牙时，哪一项最不重要
A. 基牙的固位能力
B. 各基牙的共同就位道
C. 基牙必须是活髓牙
D. 基牙的牙周组织健康
E. 基牙的支持能力

正确答案：C。基牙必须是活髓牙

解析：本题考查固定桥基牙的选择。固定桥的基牙最好是活髓牙，但并不一定非得是活髓牙（C错，为本题的正确答案），如系牙髓有病变的牙，进行完善的牙髓治疗，并经过一段时间的观察，证实病变已治愈，不影响固定桥的效果者，也可以选作基牙。固位桥靠固位体与基牙连接在一起并将牙合力通过固位体传给基牙，故基牙必须有良好的固位能力（A对）。固定桥由固位体、桥体、连接体三部分组成，固位体是固定桥粘结或粘固在基牙上的部分，各基牙必须具有共同的就位道（B对），才能使固定桥就位。基牙要承担自身的和桥体的牙合力，必须要求基牙牙周组织健康（D对）。固位桥承受的咬合力最后都是由基牙承担的，基牙必须有良好的支持能力（E对）以支撑固定桥。